心绞痛发作时，首选的速效药物是
A. 普萘洛尔（心得安）
B. 硝苯地平（心痛定）
C. 硝酸异山梨醇酯（消心痛）
D. 硝酸甘油
E. 硝苯地平

正确答案：D。硝酸甘油

解析：心绞痛发作的主要病理机制是心肌需氧和供氧间的平衡失调，致使心肌暂时性缺血缺氧，继而产生无氧代谢产物，聚集在心肌组织刺激心肌传入神经末梢至中枢后引发疼痛，硝酸甘油（D对）能够直接松弛血管平滑肌，降低心肌耗氧，增加缺血区血流供应，舌下含服，起效迅速，为心绞痛发作时的首选速效药。普萘洛尔（心得安）（A错）为β受体阻断药，为治疗临床心绞痛的常用药物和有效药物，对于稳定性心绞痛，主要用于对硝酸酯类疗效差的患者，对伴有心率加快、高血压和心律失常的患者更为实用，禁用于变异性心绞痛。硝苯地平（心痛定）（BE错）属于二氢吡啶类，对平滑肌作用大于心脏，对变异性心绞痛效果好，对稳定性心绞痛效果不如β受体阻断药。硝酸异山梨酯（消心痛）（C错）为长效硝酸酯类药物，药理作用与硝酸甘油相似而强度较弱，舌下含服起效较慢，口服约20-30分钟起效，主要用于预防心绞痛。